下列可造成血压明显升高的药品是
A. 麻黄碱
B. 异丙肾上腺素
C. 两者均能
D. 两者均不能

正确答案：A。麻黄碱

解析：本题考查造成血压升高的药物。下列可造成血压明显升高的药品是麻黄碱（A对）。麻黄碱为α、β受体激动剂，升高血药较缓慢，但维持时间较久，收缩压升高较舒张压明显，脉压加大。异丙肾上腺素为β受体激动剂。由于心脏兴奋和外周血管舒张，使收缩压升高而舒张压略下降，大剂量静脉注射时，可引起明显的血压下降（BCD错）。